乳酸循环所需的NADH主要来自
A. 三羧酸循环过程中产生的NADH
B. 脂酸β-氧化过程中产生的NADH
C. 糖酵解过程中3-磷酸甘油醛脱氢产生的NADH
D. 磷酸戊糖途径产生的NADPH经转氢生成的NADH
E. 谷氨酸脱氢产生的NADH

正确答案：C。糖酵解过程中3-磷酸甘油醛脱氢产生的NADH

解析：乳酸循环所需的NADH主要来自糖酵解过程中3-磷酸甘油醛脱氢产生的NADH（C对）。糖酵解途径中，3-磷酸甘油醛氧化为1，3-二磷酸甘油酸的反应中，以NAD⁺为辅酶接受氢和电子，生成NADH+H⁺，在缺氧情况下，这一对氢用于还原丙酮酸生成乳酸。